下列保健食品的批准文号，符合国家食品药品监督管理部门批准的进口保健食品批准文号格式的是
A. 国食健字G2012××××
B. 国食健字（2000）第××××号
C. 国食健注J2013××××号
D. 国食健进字（2004）第××××号

正确答案：C。国食健注J2013××××号

解析：本题考查保健食品批准文号管理。下列保健食品的批准文号，符合国家食品药品监督管理部门批准的进口保健食品批准文号格式的是国食健注J2013××××号（C对）。保健食品批准文号管理：2016年2月4日，经原国家食品药品监督管理总局局务会议审议通过了《保健食品注册与备案管理办法》，自2016年7月1日起施行。新修订的管理办法依据新食品安全法，对保健食品实行注册与备案相结合的分类管理制度。对注册的保健食品，国产保健食品注册号格式为：国食健注G+4位年代号+4位顺序号（A错）；进口保健食品注册号格式为：国食健注J+4位年代号+4位顺序号。保健食品注册证书有效期为5年。变更注册的保健食品注册证书有效期与原保健食品注册证书有效期相同。对备案的保健食品，按照相关要求的格式制作备案凭证，并将备案信息表中登载的信息在其网站上公布。国产保健食品备案号格式为：食健备G+4位年代号+2位省级行政区域代码+6位顺序编号；进口保健食品备案号格式为：食健备J+4位年代号+00+6位顺序编号。